女，48岁。月经不规则2年余，阴道不规则流血20天。查体：中度贫血貌，子宫略大，稍软，无压痛，宫旁未触及异常。为确定诊断，就首选的检查是
A. 盆腔CT检查
B. 尿hCG测定
C. 分段诊刮
D. 盆腔B超
E. 阴道镜检查

正确答案：C。分段诊刮

解析：患者女，48岁（处于绝经过渡期，始于40岁，历时约1～20年），月经不规则2年余，阴道不规则流血20天（对于绝经后阴道流血、绝经过渡期月经紊乱，均应排除子宫内膜癌后再按良性疾病处理）。查体：中度贫血貌，子宫略大（晚期可有子宫增大），稍软，无压痛，宫旁未触及异常，考虑子宫内膜癌。为确定诊断，首选的检查是分段诊刮（C对）。当临床上子宫内膜癌与绝经过渡期功血难以鉴别，应先行分段刮宫，确诊后再对症处理。盆腔B超（D错）检查可对异常阴道流血的原因作出初步判断并为进一步检查的选择提供参考。盆腔CT检查（P316）（A错）主要用于判断肿瘤有无子宫外转移。尿hCG测定（P042）（B错）主要用于早早孕诊断。阴道镜检查（P443）（E错）主要用于观察阴道和宫颈，对可疑部位行定位活检。